石韦原植物所属的科是
A. 小檗科
B. 蓼科
C. 十字花科
D. 蔷薇科
E. 水龙骨科

正确答案：E。水龙骨科

解析：本题考查的是石韦的来源。石韦原植物所属的科是（E对）。石韦【来源】水龙骨科植物庐山石韦、石韦或有柄石韦的干燥叶。来源于小檗科（A错）的中药有淫羊藿等。来源于蓼科（B错）的中药有大黄、何首乌、虎杖、蓼大青叶等。来源于十字花科（C错）的中药有大青叶、板蓝根、青黛、莱菔子等。来源于蔷薇科（D错）的中药有地榆、枇杷叶、木瓜、山楂、苦杏仁、桃仁、乌梅、金樱子等。